恶性黑色素瘤常发生广泛转移，早期转移至区域性淋巴结占有的比例约为
A. 0.2
B. 0.3
C. 0.4
D. 0.5
E. 0.7

正确答案：E。0.7

解析：本题考查恶性黑色素瘤。恶性黑色素瘤常发生广泛转移，约70%（E对）早期转移至区域性淋巴结。肿瘤又可经血流转移至肺、肝、骨、脑等器官，其远处转移率可高达40%。